不属于咀嚼肌范畴的肌是
A. 咬肌
B. 颞肌
C. 茎突舌肌
D. 翼外肌
E. 翼内肌

正确答案：C。茎突舌肌

解析：咀嚼肌是运动下颌的主要肌肉，主要包括咬肌、颞肌、翼内肌、翼外肌，受三叉神经下颌支支配。广义的咀嚼肌还包括舌骨上肌群。茎突舌肌属于舌外肌。掌握“咀嚼肌、颈部肌及口颌系统肌链”知识点。